人格的重要方面是
A. 人格特质性
B. 人格模式性
C. 人格维度性
D. 人格倾向性
E. 人格特征性

正确答案：D。人格倾向性

解析：人格倾向性是人格的重要方面，它是个体行为的内在动力和基本原因。人格倾向性包括需要、动机、兴趣、信念和世界观等内容。这里介绍需要和动机。掌握“需要与动机”知识点。